莱姆病的病原体是
A. 梅毒螺旋体
B. 回归热螺旋体
C. 奋森疏螺旋体
D. 钩端螺旋体
E. 伯氏疏螺旋体

正确答案：E。伯氏疏螺旋体

解析：本题考查莱姆病的病原体。莱姆病的病原体是伯氏疏螺旋体（E对）。梅毒螺旋体（A错）是梅毒的病原体。回归热螺旋体（B错）流行性回归热的病原体。奋森疏螺旋体（C错）是多种口腔感染的病原体，属于条件致病菌。钩端螺旋体（D错）是钩端螺旋体病的病原体。